对神经、骨骼肌和心肌来说，均是抑制性阳离子的是
A. Na⁺
B. K⁺
C. Ca²⁺
D. Mg²⁺
E. HCO₃⁻

正确答案：D。Mg²⁺

解析：Mg2+（D对）对神经、骨骼肌和心肌均有抑制作用，血镁浓度增高可导致为肌无力甚至弛缓性麻痹、腱反射减弱或消失、心动过缓和传导阻滞。急性轻度高钾血症（B错）时心肌细胞静息电位(Em)负值减小，细胞的兴奋性增高。Na＋（A错）、HCO₃⁻（E错）主要影响细胞内外渗透压。Ca²⁺（C错）作为第二信使参与肌肉收缩的信号转导。